男，45岁。行走时右小腿和足部出现间歇性疼痛1年余。近3个月夜间呈持续性疼痛，足趾呈紫黑色、干冷。吸烟史20余年，每日2包。该患者不应该选择的治疗措施是
A. 严格戒烟
B. 手术治疗
C. 高压氧仓治疗
D. 热疗
E. 绐予止痛剂及镇静剂

正确答案：D。热疗

解析：患者中年男性（血栓闭塞性脉管炎好发人群）。行走时右小腿和足部出现间歇性疼痛1年余，近3个月夜间呈持续性疼痛（血栓闭塞性脉管炎患者患肢感觉异常及疼痛，早期起因于血管壁炎症刺激末梢神经，后因动脉阻塞造成缺血性疼痛，即间歇性跛行或静息痛），足趾呈紫黑色、干冷（长期慢性缺血导致组织营养障碍改变，严重缺血时患肢末端出现缺血性溃疡或坏疽）。吸烟史20余年，每日2包（主动或被动吸烟是血栓闭塞性脉管炎发生和发展的重要因素），综上，该患者诊断为血栓闭塞性脉管炎（P489）。本病处理一般疗法包括严格戒烟（A对）、防止受冷、受潮和外伤，但不应使用热疗（D错，为本题正确答案），以免组织需氧量增加而加重症状。疼痛严重者，可用止痛剂及镇静剂（E对），慎用易成瘾的药物。非手术治疗可选用高压氧舱治疗（C对）。手术治疗（B对）目的是重建动脉血流通道，增加肢体血供，改善缺血引起的后果（P490）。